由于影响药物代谢而产生的药物相互作用有
A. 苯巴比妥使华法林的抗凝血作用减弱
B. 异烟肼与卡马西平合用，肝毒性加重
C. 保泰松使华法林的抗凝作用增强
D. 诺氟沙星与硫酸亚铁同时服用，抗菌作用减弱
E. 酮康唑与特非那定合用导致心律失常

正确答案：A、B、E。苯巴比妥使华法林的抗凝血作用减弱；异烟肼与卡马西平合用，肝毒性加重；酮康唑与特非那定合用导致心律失常

解析：本题考查影响药物的代谢作用。苯巴比妥为肝药酶诱导剂，与华法林合用可加速华法林的代谢，使华法林抗凝作用减弱，凝血酶原时间缩短（A对）。卡马西平为肝药酶诱导剂，与异烟肼合用可加速异烟肼的代谢，增加肼类中间产物的浓度，提高药物性肝炎的发生率（B对）。酮康唑为肝药酶抑制剂，与特非那定合用可减慢特非那定的代谢，使药物在体内蓄积而引起尖端扭转型室性心律失常（E对）。保泰松使华法林的抗凝作用增强（C错）是影响药物的分布而产生的药物相互作用。诺氟沙星与硫酸亚铁同时服用，抗菌作用减弱（D错）是影响药物的吸收而产生的药物相互作用。